乳核的好发年龄是
A. 10~15岁
B. 15~20岁
C. 20~25岁
D. 25~30岁
E. 30~45岁

正确答案：C。20~25岁

解析：乳核好发于20~25岁（C对），其次是15~20岁（B错）和25~30岁（D错）女性。乳癖好发于30~45岁女性（E错）。